关于流行病学研究设计与Mill法则的关系，不正确的是
A. 每种研究设计均与某一条法则一一对应
B. 病例系列研究体现了求同法
C. 病例对照研究体现了同异共求法
D. 队列研究体现了同异共求法
E. 随机对照试验体现了同异共求法

正确答案：A。每种研究设计均与某一条法则一一对应

解析：本题考查穆勒法则与流行病学研究设计的关系。穆勒法则包括求同法、求异法、同异共求法、剩余法和共变法5个逻辑归纳法则。病例系列研究体现了求同法（B对）。病例对照研究、队列研究和随机对照试验体现了同异共求法（CDE对）。每种研究设计往往需要多种法则（A错，为本题正确答案），例如队列研究和随机对照试验有机融合了穆勒的四个法则，并同时考证了因和果的时间顺序和因变性。